经过检测，某食物每百克视黄醇当量为310μg，能量138kcal。现已知推荐的每日膳食中营养素供给量，成年轻体力劳动者视黄醇当量为800μg，能量为2600kcal。能量密度为
A. 5.308×10⁻²
B. 0.2219
C. 0. 3077
D. 0. 5373
E. 4. 506

正确答案：A。5.308×10⁻²